某男，68岁。患高血压病5年，冠心病1年，服用西药血压控制尚平稳。近1月时有头痛头胀、面红目赤、心烦易怒，舌红、苔少、脉细弦。证属阴虚阳亢。处方：天麻9g，钩藤12g（后下），石决明20g（先煎），生牡蛎30g（先煎），栀子6g，生白芍12g，炒杜仲12g，车前子15g（包煎），菊花12g，川芎10g，牛膝12g。上述所选成药的使用注意事项不包括
A. 孕妇忌用
B. 年老体弱者慎用
C. 阴虚风动者慎用
D. 大便秘结者慎用
E. 不宜过量服用或久用

正确答案：D。大便秘结者慎用

解析：本题考查的是抗栓再造丸的注意事项。某男，68岁。患高血压病5年，冠心病1年，服用西药血压控制尚平稳。近1月时有头痛头胀、面红目赤、心烦易怒，舌红、苔少、脉细弦。证属阴虚阳亢。处方：天麻9g，钩藤12g（后下），石决明20g（先煎），生牡蛎30g（先煎），栀子6g，生白芍12g，炒杜仲12g，车前子15g（包煎），菊花12g，川芎10g，牛膝12g。上述所选成药的使用注意事项不包括大便秘结者慎用（D错，为本题正确答案）。抗栓再造丸：【注意事项】本品所含朱砂、土鳖虫、全蝎、水蛭等有毒，故孕妇忌用（A对），不宜过量服用或久用（E对）。年老体弱、阴虚风动者慎用（BC对）。华佗再造丸：【注意事项】孕妇忌服。中风痰热壅盛证，表现为面红目赤、大便秘结者不宜用。平素大便干燥者慎用。服药期间忌辛辣、生冷、油腻食物。